根据《执业药师资格制度暂行规定》，通过非法手段获取《执业药师资格证书》或《执业药师注册证》的人员，发证机构应
A. 收回《执业药师资格证书》
B. 取消执业药师资格
C. 注销《执业药师注册证》
D. 通报批评
E. 给予行政处罚

正确答案：A、B、C。收回《执业药师资格证书》；取消执业药师资格；注销《执业药师注册证》

解析：本题考查执业药师管理。根据《执业药师资格制度暂行规定》，通过非法手段获取《执业药师资格证书》或《执业药师注册证》的人员，发证机构应收回《执业药师资格证书》（A对）、取消执业药师资格（B对）、注销《执业药师注册证》（C对）。